子痫前期的患者，用硫酸镁治疗中发现病人呼吸14次/分，膝反射消失，尿量400ml/24h。此时应立即首先给
A. 肌注吗啡
B. 吸氧
C. 冬眠合剂全量肌注
D. 停用硫酸镁并静注钙剂
E. 静脉注射安定

正确答案：D。停用硫酸镁并静注钙剂

解析：膝反射消失是硫酸镁中毒的首要表现，另外呼吸14次/分，尿量400ml/24h都是硫酸镁中毒的表现。硫酸镁中毒时，需利用钙剂解毒。故答案选D。掌握“娠期高血压疾病”知识点。